关于苯妥英钠，哪项错误
A. 不宜肌内注射
B. 无镇静催眠作用
C. 抗癫痫作用与开放钠通道有关
D. 血药浓度过高则按零级动力学消除
E. 有诱导肝药酶的作用

正确答案：C。抗癫痫作用与开放钠通道有关